合成类抗结核药
A. 诺氟沙星
B. 盐酸环丙沙星
C. 氧氟沙星
D. 利福平
E. 盐酸乙胺丁醇

正确答案：E。盐酸乙胺丁醇